男，70岁，软弱无力，进食减少，口渴、多尿2周，近2天嗜睡。急诊检查：BP70/50mmHg，神志朦胧，皮肤干燥失水，呼吸34次/分，心率108次/分，尿糖（++++），尿酮（±）。既往无糖尿病史。最可能的诊断是
A. 糖尿病肾病
B. 糖尿病性神经病变
C. 糖尿病酮症酸中毒
D. 糖尿病乳酸性酸中毒
E. 高渗性非酮症糖尿病昏迷

正确答案：E。高渗性非酮症糖尿病昏迷

解析：老年男性患者、既往无糖尿病病史（高渗性非酮症糖尿病昏迷的好发人群），近2周出现口渴、多尿、软弱无力、进食减少，近2天嗜睡，查体出现血压下降与脱水表现、意识障碍（高渗性非酮症糖尿病昏迷典型临床表现），化验尿糖强阳性，尿酮体弱阳性，应考虑诊断为高渗性非酮症糖尿病昏迷（E对）。糖尿病肾病（A错）多见于糖尿病病史10年以上者，表现为蛋白尿、可伴有水肿和高血压、肾功能逐渐减退，而无脱水、嗜睡、血压降低等表现。糖尿病性神经病变（B错）常表现为双下肢远端感觉运动障碍，起病缓慢，无脱水、嗜睡、血压降低等表现。糖尿病酮症酸中毒（C错）以高血糖、酮症和酸中毒为主要表现（P745），患者亦出现脱水与意识障碍，但其呼吸深快、呼气有烂苹果味，尿糖和尿酮均阳性。糖尿病乳酸性酸中毒（D错）为使用双胍类药物的罕见并发症，实验室检查血乳酸增高（＞5mmol/L），血PH＜7.35。